腹膜返折以上直肠癌早期淋巴转移的主要途径是
A. 向直肠上动脉旁淋巴结转移
B. 向腹股沟淋巴结转移
C. 向骼内淋巴结转移
D. 向直肠下动脉旁淋巴结转移
E. 向侧方淋巴结转移

正确答案：A。向直肠上动脉旁淋巴结转移

解析：腹膜返折以上直肠癌早期淋巴转移的主要途径是向直肠上动脉旁淋巴结转移（A对）。向腹股沟淋巴结转移（B错）、向骼内淋巴结转移（C错）、向直肠下动脉旁淋巴结转移（D错）、向侧方淋巴结转移（E错）是腹膜返折以下直肠癌的主要淋巴转移途径。